患者，男，70岁。家属代诉患者近晨起床后半小时，突然昏仆，不省人事，目合口张，遗溺，手撒，四肢厥冷，脉细弱。治疗用隔盐灸，应首选
A. 肾俞、太溪
B. 关元、神阙
C. 脾俞、足三里
D. 肾俞、三阴交
E. 三焦俞、内关

正确答案：B。关元、神阙

解析：本题考查常见的病症的辩证、处方。患者晕厥，目合口张、遗溺、手撒、四肢厥冷，可诊断为中风中脏腑之脱证，主穴：内关、水沟，配穴选关元、气海、神阙穴，关元、气海用大艾柱灸法，神阙用隔盐灸法，以达到回阳、救逆、固脱（B对）。肾俞、太溪可温阳补肺肾，但却不能回阳救逆（A错）。脾俞、足三里可补益脾胃，但此乃急症，非正治（C错）。肾俞、三阴交补肾益阴可，但不能回阳救逆（D错）。三焦俞、内关可调理三焦气机通畅，可用于气厥证，但不适用于此脱证以现的病患（E错）。